合成酮体的关键酶是
A. HMG-CoA合成酶
B. HMG-CoA还原酶
C. 琥珀酰CoA转硫酶
D. 乙酰CoA羧化酶
E. 已糖激酶

正确答案：A。HMG-CoA合成酶